脘腹痞闷，食少难消，大便溏薄，倦怠乏力，苔腻微黄，脉虚弱者，治宜选用
A. 越鞠丸
B. 健脾丸
C. 半夏泻心汤
D. 参苓白术散
E. 厚朴温中汤

正确答案：B。健脾丸

解析：该题考查健脾丸的主治病证。脘腹痞闷，食少难消，大便溏薄为食积证。倦怠乏力，脉虚弱为脾虚的表现。越鞠丸功能行气解郁，主治六郁证（A错）。健脾丸功能健脾和胃，消食止泻，主治脾虚食积证（B对）。半夏泻心汤功能寒热平调，消痞散结，主治寒热错杂之痞证（C错）。参苓白术散功能益气健脾，渗湿止泻，主治脾虚湿盛证（D错）。厚朴温中汤功能行气除满，温中燥湿（E错）。